公共卫生的功能不包括
A. 提供公平有效的公共服务
B. 预防疾病的发生和传播
C. 预防意外伤害
D. 研究具体的临床治疗措施
E. 促进和鼓励健康行为

正确答案：D。研究具体的临床治疗措施

解析：公共卫生是通过有组织的社区努力来预防疾病、延长寿命、促进健康和提高效益的科学和艺术。研究具体的临床治疗措施是临床医师在面对具体患者时的任务，不属于公共卫生范畴（D错，为本题正确答案）。提供公平有效的公共服务（A对）、预防疾病的发生和传播（B对）、预防意外伤害（C对）和促进和鼓励健康行为（E对）是公共卫生具体功能之一。